经迟寒凝证，宜加用
A. 肾俞太溪
B. 命门关元
C. 太溪
D. 行间
E. 足三里脾俞

正确答案：B。命门关元

解析：月经后期的虚寒证配命门、关元，以温补肾阳，培本固元（B对）。月经先后无定期的肾虚证配肾俞、太溪（A错）。月经先期的虚热证配太溪（C错）。带下病的湿热下注证配行间（D错）。月经先后无定期的脾虚证配足三里、脾俞（E错）。